在小骨盆入口处左输尿管越过
A. 左髂总动脉的末端后面
B. 左髂外动脉的起始部
C. 左髂内动脉的起始部
D. 左髂总动脉的末端前面
E. 左髂内动脉的末端前面

正确答案：D。左髂总动脉的末端前面

解析：左输尿管在小骨盆入口越过左髂总动脉末端前方（D对）。